囊性淋巴管瘤的临床表现如下，除外
A. 好发于儿童及青少年
B. 主要发生于颈部锁骨上
C. 表面皮肤正常，柔软有波动感
D. 内有透明浅黄色水样液体
E. 有可压缩性，体位移动试验阳性

正确答案：E。有可压缩性，体位移动试验阳性

解析：本题考查囊性淋巴管瘤的临床表现。囊性淋巴管瘤体位移动实验阴性（E错，为本题的正确答案），但透光实验阳性，不可被压缩。海绵状血管瘤体位移动试验阳性：当头低位时病损区则充血膨大，恢复正常位置后，肿胀亦随之缩小，恢复原状，有可压缩性，有时可扪到静脉石。囊性淋巴管瘤是淋巴管畸形中的大囊型这一类型。囊性淋巴管瘤又叫囊性水瘤，常见于儿童及青少年（A对），主要发生于颈部、锁骨上区（B对），亦可发生于下颌下区及颈上部。一般为多房性囊腔，彼此间隔，内有透明、淡黄色水样液体（D对）。表面皮肤色泽正常，扪诊柔软，有波动感（C对）。